以下哪项是健康教育的核心
A. 健康检查
B. 健康行为
C. 保健宣传
D. 预防性知识培训
E. 健康课程宣讲

正确答案：B。健康行为

解析：健康行为是健康教育的核心，同时也是大多数健康教育干预研究的评价指标和项目目标。掌握“干预基本模式及烟草行为干预”知识点。